糖皮质激素的不良反应不包括
A. 向心性肥胖、高血压
B. 加重感染、血糖下降
C. 骨质疏松、青光眼
D. 消化道溃疡、肌萎缩
E. 伤口愈合延缓、高血脂

正确答案：B。加重感染、血糖下降

解析：本题考查糖皮质激素的不良反应。糖皮质激素的不良反应不包括加重感染、血糖下降（B错，为本题的正确答案）。长期大剂量应用引起的不良反应包括：1.医源性肾上腺皮质功能亢进：满月脸、水牛背、皮肤变薄、多毛、水肿、低血钾、高血压、向心性肥胖、糖尿病等；2.诱发或加重感染；3.消化系统并发症：可诱发或加剧胃、十二指肠溃疡，甚至造成消化道出血或穿孔。对少数患者可诱发胰腺炎或脂肪肝；4.心血管系统并发症：长期应用，由于钠、水潴留和血脂升高可引起高血压（A对）和动脉粥样硬化（E对）；5.骨质疏松（C对）、肌肉萎缩（D对）、伤口愈合迟缓等；6.糖尿病；7.其他：有癞痫或精神病史者禁用或慎用。